研究体重跟身高的关系，所用的统计图
A. 直方图
B. 直条图
C. 散点图
D. 线图
E. 圆图

正确答案：C。散点图

解析：直方图它主要用于表示连续变量频数分布情况（A错）。直条图和圆图是描述定性数据的统计图（BE错）。散点图用点的密集程度和变化趋势表示两指标之间的直线或曲线关系（C对）。线图适用于描述一个变量随另一个变化的趋势和波动情况（D错）。